梅核气为痰气凝结于
A. 经络
B. 咽喉
C. 筋骨
D. 胸胁
E. 胸膈

正确答案：B。咽喉

解析：本题考查的是痰饮的致病特点。梅核气为痰气凝结于咽喉（B对）。痰饮可阻滞气血运行：痰饮为实邪，可随气流行全身，或停滞于经脉，或留滞于脏腑，阻滞气机，妨碍气血运行。若痰饮流注于经络（A错），则致经络气机阻滞，气血运行不畅，出现肢体麻木，屈伸不利，甚至半身不遂，或形成瘰疬痰核，阴疽流注等；若痰饮留滞于脏腑，则阻滞脏腑气机，使脏腑气机升降失常。如痰饮阻肺，肺气失于宣降，则见胸闷气喘，咳嗽吐痰等；痰饮停胃，胃气失于和降，则见恶心呕吐等；痰浊痹阻心脉，血气运行不畅，可见胸闷心痛；无形之痰气结滞于咽喉，则形成“梅核气”，临床常见咽中梗阻如有异物，咽之不下，吐之不出，胸膈（E错）满闷，情绪低落，善太息等。痰饮在筋骨（C错）或胸胁（D错），2022年考试指南未明确说明。